硫酸盐类药材有
A. 朱砂
B. 石膏
C. 炉甘石
D. 滑石
E. 自然铜

正确答案：B。石膏

解析：本题考查的是矿物的分类。硫酸盐类药材有石膏（B对）。矿物类中药按阴离子分类法分类：朱砂（A错）、雄黄、自然铜（E错）等为硫化合物类；石膏、芒硝、白矾为硫酸盐类；炉甘石（C错）、鹅管石为碳酸盐类；磁石、赭石、信石为氧化物类；轻粉为卤化合物类。滑石（D错）为硅酸盐类。